某温度计厂男工，42岁，工作十余年。近来有乏力、记忆力减退、失眠和多梦等症，常因琐事与人口角、事后又忧郁胆怯，近日发现他的字迹弯弯曲曲。该工人接触的生产性毒物在空气中存在的主要形态是
A. 烟尘
B. 粉尘
C. 蒸气
D. 雾
E. 气溶胶

正确答案：C。蒸气

解析：本题考查汞的理化性质。汞中毒初期表现为类神经症，如头昏、乏力、健忘、失眠、多梦、易激动等，部分病例可有心悸、多汗等自主神经系统紊乱现象，病情进一步发展则会发生性格改变，如急躁、易怒、胆怯、害羞、多疑等。震颤是神经毒性的早期症状，如头部震颤和运动失调。题中工人的自主神经系统紊乱和性格改变等现象是由于长期接触汞引起的慢性汞中毒。而汞的熔点低，易蒸发，在常温条件下即可蒸发为气体，以蒸气（C对ABDE错）的形态存在。